下列检测器中，在气相色谱法和高效液相色谱法中，均可使用的是
A. 紫外检测器
B. 火焰离子化检测器
C. 质谱检测器
D. 热导检测器
E. 电化学检测器

正确答案：C。质谱检测器

解析：本题考查色谱法所用仪器。质谱检测器（C对）在气相色谱法和高效液相色谱法中均可使用。气相色谱仪常用检测器包括热导检测器、氢火焰离子化检测器、电子捕获检测器、质谱检测器等。高效液相色谱常用的检测器有紫外检测器、示差折光检测器、荧光检测器及质谱检测器。